用作复方口服避孕药成分之一的雌激素是
A. 雌二醇
B. 尼尔雌醇
C. 己烯雌酚
D. 炔诺酮
E. 炔雌醇

正确答案：E。炔雌醇

解析：本题考查炔雌醇。用作复方口服避孕药成分之一的雌激素是炔雌醇（E对）。雌二醇（A错）用于功能性子宫出血、原发性闭经、绝经期综合征以及前列腺癌等。尼尔雌醇（B错）主要用于雌激素缺乏引起的绝经期或更年期综合征。乙烯雌酚（C错）用于卵巢功能不全或垂体功能异常引起的各种疾病。炔诺酮（D错）用于避孕和功能性子宫出血。